切支托凹位于下颌尖牙近中切嵴，宽约
A. 1mm
B. 1.5mm
C. 2mm
D. 2.5mm
E. 3mm

正确答案：D。2.5mm

解析：切支托凹预备：切支托凹位于下颌尖牙近中切嵴或下颌切牙的切端，宽约2.5mm，深1～1.5mm，呈浅凹形，由唇舌两个凹斜面构成。掌握“局部义齿修复前的准备及牙体预备”知识点。